治疗小儿急惊风感受风邪证，应首选
A. 桑菊饮
B. 银翘散
C. 抱龙丸
D. 安神丸
E. 麻杏石甘汤

正确答案：B。银翘散

解析：急惊风为痰、热、惊、风四证俱备，临床以高热、抽风、神昏为主要表现。风热之邪或从口鼻而入，易于传变，郁而化热，热极生风，治以银翘散，可疏风清热，息风定惊（B对）。桑菊饮善于治疗风热犯肺之咳嗽，症见咳嗽不爽，痰黄黏稠（A错）。抱龙丸主治脾胃不和，风热痰内蕴所致的腹泻，症见食乳不化、恶心呕吐、大便稀、有不消化食物（C错）。安神丸益气养血，安神宁心，适用于失眠，头昏，耳鸣，心悸，健忘（D错）。麻杏石甘汤治疗肺炎喘嗽的重症，症见高热不退，咳嗽频频，气急鼻煽，喉中痰鸣（E错）。